下列哪项药物作用机制为与二价金属离子络合，干扰细菌RNA的合成，可抑制结核分枝杆菌
A. 利福平
B. 红霉素
C. 链霉素
D. 四环素
E. 乙胺丁醇

正确答案：E。乙胺丁醇

解析：乙胺丁醇的作用机制为与二价金属离子络合，干扰细菌RNA的合成，起到抑制结核分枝杆菌的作用。掌握“异烟肼、利福平及乙胺丁醇”知识点。